根据《中华人民共和国药典临床用药须知》中规定，在注射前必须做皮试的药物是
A. 红霉素
B. 氨苄西林
C. 克林霉素
D. 维生素K₁
E. 万古霉素

正确答案：B。氨苄西林

解析：本题考查氨苄西林。在注射前必须做皮试的药物是氨苄西林（B对）。氨苄西林属青霉素类抗菌药物，青霉素类可引起严重的过敏反应。在注射前，可以选用250～500U/ml浓度的青霉素溶液皮内注射0.05～0.1ml，做所有青霉素类药的皮肤敏感试验，经20min观察皮试结果，呈阳性反应者禁用。红霉素（A错）、克林霉素（C错）少见过敏反应，无需做皮试。注射维生素K₁（D错）用药前应详细询问患者的过敏史，对维生素K₁及注射液所含成分过敏者禁用，过敏体质者慎用。在给药期间应对患者密切观察，一旦出现过敏症状，立即停药并进行救治。万古霉素（E错）应注意滴注速度，滴注速度过快，可产生红斑样或荨麻疹样反应，皮肤发红（称为红人综合征），尤以躯干上部为甚。